一份考卷有3个问题，每个问题1分，班级中20％得3分，60％得2分，10％得1分，10％得0分，则学生的平均得分X是
A. 1.5
B. 1.9
C. 2.1
D. 2.2
E. 不知道班级中有多少人，所以不能算出平均得分

正确答案：B。1.9

解析：本题考查算数均数的相关内容。由均数的加数计算公式可计算平均得分X=3×0.2+2×0.6+1×0.1+0×0.1=1.9（B对ACD错）。尽管班级人数未知，但只要有不同得分的比例（频率），仍可算出平均分(E错）。